临床创口的初期愈合时间为
A. 6～10天
B. 10～15天
C. 10～20天
D. 15～20天
E. 20～30天

正确答案：A。6～10天

解析：一般这种结缔组织的成熟视不同部位和张力大小，6～10天即达到临床创口的初期愈合。掌握“口外创口处理”知识点。